关于筛检的应用正确的是
A. 在表面健康人群中发现可疑的肺结核患者
B. 某幼儿园的一次食物中毒的调查
C. 对个别发生的肺结核病人进行调查
D. 调查某学校乙型肝炎感染情况，可不必调查该校的全部学生
E. 用于早期发现、早期诊断、早期治疗肝癌

正确答案：A。在表面健康人群中发现可疑的肺结核患者

解析：本题考查筛检。筛检是针对临床前期或早期的疾病阶段，运用快速、简便的试验、检查或其他方法，将未察觉或未诊断疾病的人群中那些可能有病或缺陷、但表面健康的个体，同那些可能无病者鉴别开来（A对BCDE错）的一系列医疗卫生服务措施。